静脉滴注两性霉素B50mg，滴注时间应控制在
A. 0.5h以上
B. 1h以上
C. 2h以上
D. 4h以上
E. 6h以上

正确答案：E。6h以上

解析：本题考查两性霉素B的使用。注射用两性霉素B宜缓慢避光滴注，每剂滴注时间至少6小时（E对）。